下列除哪一条外均为门脉高压症的临床表现
A. 外周静脉压升高
B. 腹壁静脉扩张
C. 腹水
D. 食管静脉曲张
E. 脾肿大

正确答案：A。外周静脉压升高

解析：门脉高压症的临床表现为第一，脾大（E对），是因为皮下淤血所导致的，出现轻中度脾脏增大，晚期可伴有脾功能亢进，表现为白细胞，血小板，红细胞计数减少。第二，侧枝循环的建立和开放，当门静脉高压达到200毫米汞柱以上时，导致门静脉和腔静脉之间建立许多侧枝循环。主要包括三条路径：食管下段和胃底静脉曲张（D对），腹壁和脐周静脉曲张（B对），痔静脉曲张。第三，腹水（C对）。外周静脉压升高的原因，通常心脏泵血功能减退时，中心静脉压会升高，而外周静脉压也会升高（A错，为本题正确答案）。